尿路感染的易感因素不包括
A. 膀胱输尿管反流
B. 留置导尿管
C. 神经源性膀胱
D. 糖尿病
E. 青年男性

正确答案：E。青年男性

解析：女性因特殊解剖结构而成为尿路感染的易感因素，青年男性（E错，为本题正确答案），除非伴有泌尿生殖系统异常等易感因素，极少发生尿路感染，但65岁以上男性尿路感染发病率明显增加，几乎与女性相近，主要与前列腺肥大或前列腺炎有关。膀胱输尿管反流（A对）发生障碍时，导致细菌在局部定植，发生感染。神经源性膀胱（C对）发生时，支配膀胱的神经功能障碍，因长时间的尿液滞留和（或）应用导尿管引流尿液导致感染。糖尿病（D对）发生时，患者免疫力低下，尿路感染、无症状性细菌尿的发病率较无糖尿病者增加2-3倍。